患者戴用全口义齿1周后，自诉义齿易松动。如果病人说明仅在吃饭时义齿易掉，应该重点检查什么
A. 检查义齿的平衡（牙合）
B. 检查基托边缘伸展
C. 检查人工牙的排列
D. 检查后堤区怎样
E. 检查系带是否让开

正确答案：A。检查义齿的平衡（牙合）

解析：本题考查全口义齿固位不良的情况及原因。全口义齿易松动即固位不良。如果仅在吃饭时义齿易掉，说明义齿松动是由（牙合）不平衡造成的，当（牙合）不平衡时，牙尖有干扰，使义齿翘动，破坏了边缘封闭，导致义齿在吃饭时易掉。所以应该重点检查义齿的平衡（牙合）（A对）。检查基托边缘伸展（B错）应在当口腔处于休息状态时，义齿容易松动脱落的情况下进行。检查人工牙的排列（C错）、检查后堤区怎样（D错）、检查系带是否让开（E错）应在当口腔处于休息状态时，义齿固位尚好，但张口、说话、打哈欠时义齿易脱位的情况下进行。